关于鸟氨酸循环的叙述，正确的是
A. 鸟氨酸循环从鸟氨酸与氨结合生成瓜氨酸开始
B. 鸟氨酸循环从氨基甲酰磷酸合成开始
C. 每次经历1次鸟氨酸循环消耗1分子氨
D. 每经历1次鸟氨酸循环消耗2分子ATP
E. 鸟氨酸循环主要在肝内进行

正确答案：E。鸟氨酸循环主要在肝内进行

解析：鸟氨酸循环主要在肝内胞浆和线粒体中进行（E对），鸟氨酸循环从氨基甲酰磷酸合成开始（B对），NH₃、CO₂和ATP生成氨基甲酰磷酸，然后氨基甲酰磷酸再与鸟氨酸结合生成瓜氨酸（A错）进行反应。尿素合成的总反应为：2NH₃+3ATP+3H₂O↔H₂N-CO-NH₂+2ADP+AMP+4Pi，每经历一次鸟氨酸循环消耗2分子氨（C错），消耗3分子ATP（D错）。本题BE为正确选项，原答案选择E。